试验方法的并联可使
A. 灵敏度提高
B. 特异度提高
C. 两者均可
D. 两者均否

正确答案：A。灵敏度提高

解析：本题考查并联试验。并联试验也称平行试验，即全部筛检试验同时平行开展，任何一项筛检试验结果阳性就可判定为阳性。该方法的优点是可以弥补两种方法灵敏度都不足的问题，提高筛查整体的灵敏度（A对BCD错），但会降低特异度。